碘量法测定维生素C含量，取本品0.2000g，加新沸过的冷水100m1与稀醋酸10m使溶解，加淀粉指示液1ml，立即用碘滴定液（0.1000mo1/L）滴定,至终点,消耗碘滴定液20.00ml，已知维生素C的分子量为176.13，求维生素C的含量
A. 0.981
B. 0.989
C. 0.888
D. 0.918
E. 0.881

正确答案：E。0.881